27岁初产妇，妊娠40周，阵发性腹痛10小时，宫缩10～15分钟一次，持续30秒，宫口开大2cm。此时的处理原则应是
A. 静脉滴注缩宫素
B. 静脉滴注麦角新碱
C. 肌内注射哌替啶（杜冷丁）
D. 人工破膜
E. 立即行剖宫产术

正确答案：C。肌内注射哌替啶（杜冷丁）

解析：27岁初产妇，妊娠40周，阵发性腹痛10小时，宫缩正常10~15分钟1次（正常5~10分钟一次），持续30秒（正常30~60秒），考虑协调性宫缩乏力。缩宫素（A错）和人工破膜（D错）要在宫口开大3cm后才可使用。故选择使用镇静剂（C对）。麦角新碱可选择性兴奋子宫平滑肌，但剂量稍大即可引起子宫平滑肌强直收缩，妊娠后期子宫对其敏感性增强，因此不能用于催产和引产，故静脉注射麦角新碱（B错）只能用于产后子宫出血。立即行剖宫产术（E错）适用于不能经阴道分娩或出现胎儿窘迫的产妇。